关于氯磷定的叙述，正确的是
A. 可迅速制止肌束颤动
B. 对乐果中毒疗效好
C. 属易逆性抗胆碱酯酶药
D. 不良反应较碘解磷定大
E. 对内吸磷中毒无效

正确答案：A。可迅速制止肌束颤动

解析：氯解磷定属于胆碱酯酶复活药，能够使已被有机磷酸酯抑制的AchE恢复活性，其分子中带正电荷的季铵氮与磷酰化胆碱酯酶的阴离子以静电引力相结合，污基以共价键与磷酰化胆碱酯酶的磷酰基相结合，形成的复合物再经裂解后成为无毒的磷酰化氯解磷定从尿中排出，同时使胆碱酯酶游离出来恢复水解Ach的活性，这种作用在骨骼肌神经肌肉接头处最为明显，可使肌束颤动明显减轻或消失（A对）。氯解磷定对乐果中毒无效（B错），乐果中毒所形成的磷酰化胆碱酯酶比较稳定，酶活性不易恢复，加之乐果乳剂还含有苯，同时有苯中毒。氯解磷定属于不可逆的胆碱酯酶抑制剂（C错），不良反应少见，偶有轻度头痛、眩晕、恶心、呕吐等，碘解磷定不良反应较多（D错），作用较弱，又只能静脉注射，目前已经较少使用。氯解磷定对不同有机磷酸酯类中毒疗效存在差异，对内吸磷（E错）、马拉硫磷和对硫磷中毒的疗效较好。